对腓总神经叙述，错误的是
A. 沿腘窝上角外缘经半腱肌内缘下行
B. 绕腓骨颈向前穿过腓骨长肌
C. 分为腓浅、深神经
D. 受损伤时，可引起足下垂
E. 受损伤时，可引起足内翻

正确答案：A。沿腘窝上角外缘经半腱肌内缘下行

解析：腓总神经在腘窝近侧端由坐骨神经发出后，沿构成腘窝上外侧界的股二头肌肌腱内侧向外下走行（A错，为本题正确答案），至小腿上段外侧绕腓骨颈向前穿过腓骨长肌（B对），分为腓浅神经和腓深神经两大终末支（C对）。腓总神经的肌支主要支配小腿前、外侧群肌和足背肌，因而腓总神经损伤时，小腿前、外侧群肌功能丧失，表现为足不能背屈，趾不能伸，足下垂（D对）且内翻（E对），呈“马蹄内翻足＂畸形，行走时呈“跨阈步态”。